受体部分激动药的特点是
A. 亲和力及内在活性都强
B. 具有一定亲和力但内在活性弱
C. 与亲和力和内在活性无关
D. 有亲和力、无内在活性，与受体不可逆性结合
E. 有亲和力、无内在活性，与激动剂竞争相同受体

正确答案：B。具有一定亲和力但内在活性弱

解析：本题考查作用于受体药物的分类。受体部分激动药的特点是具有一定亲和力但内在活性弱（B对）。部分激动药具有较强亲和力，但内在活性低（α＜1），与受体结合后只能产生较弱的效应。亲和力及内在活性都强（A错）的是完全激动药。与亲和力和内在活性无关（C错）的是非特异性药物。有亲和力、无内在活性，与受体不可逆性结合（D错）的是非竞争性拮抗药。有亲和力、无内在活性，与激动剂竞争相同受体（E错）的是竞争性拮抗药。